梅核气治用
A. 旋覆代赭汤
B. 百合地黄汤
C. 半夏厚朴汤
D. 甘麦大枣汤
E. 小柴胡汤

正确答案：C。半夏厚朴汤

解析：梅核气为妇人自觉咽中有物梗塞，咯之不出，吞之不下，但饮食吞咽一般无碍，还可伴有胸闷叹息等症。多由情志不畅，气郁生痰，痰气交阻，上逆于咽喉之间而成，治疗用半夏厚朴汤解郁化痰，顺气降逆（C对）。方中半夏、厚朴、生姜辛以散结，苦以降逆；辅以茯苓利饮化痰；佐以苏叶芳香宣气解郁。诸药合而用之，使气顺痰消，则咽中炙脔感可以消除。